根据《麻醉药品、第一类精神药品购用印鉴卡管理规定》，下列项目变更时不必办理《印鉴卡》变更手续的是
A. 医疗机构负责人
B. 医疗管理部门负责人
C. 药学部门负责人
D. 具有麻醉药品处方审核资格的药师
E. 麻醉药品采购人员

正确答案：D。具有麻醉药品处方审核资格的药师

解析：本题考查麻醉药品、第一类精神药品购用印鉴卡管理。根据《麻醉药品、第一类精神药品购用印鉴卡管理规定》，下列项目变更时不必办理《印鉴卡》变更手续的是具有麻醉药品处方审核资格的药师（D对）。根据《麻醉药品、第一类精神药品购用印鉴卡管理规定》，当《印鉴卡》中医疗机构名称、地址、医疗机构法人代表（负责人）（A错）、医疗管理部门负责人（B错）、药学部门负责人（C错）、采购人员（E错）等项目发生变更时，医疗机构应当在变更发生之日起3日内到市级卫生健康主管部门办理变更手续。